阿片类物质戒断综合症出现的时间一般为停药后
A. 3～4小时
B. 6～12小时
C. 1～3天
D. 3～5天
E. 7天

正确答案：B。6～12小时

解析：阿片类戒断综合征，症状于停药后6～12小时出现（B对），表现为强烈的渴求阿片类药物、流涕流泪、肌肉疼痛或抽筋、胃肠道痉挛，恶心、呕吐、腹泻、瞳孔扩大、反复寒战、心动过速等。